多形性红斑并发皮肤病损的特征性临床表现是
A. 糜烂
B. 溃疡
C. 渗出多，形成灰白色假膜
D. 疼痛明显
E. 虹膜状红斑

正确答案：E。虹膜状红斑

解析：本题考查多形性红斑皮肤病损的特征性临床表现。多形性红斑又称多形渗出性红斑，是黏膜皮肤的一种急性渗出性炎症性疾病。发病急，具有自限性和复发性。黏膜和皮肤可以同时发病，或单独发病。累及皮肤时的特征性表现为直径为0.5cm左右的圆形红斑，中心有粟粒状大小的水疱称虹膜状红斑（E对）。糜烂（A错）、溃疡（B错）、渗出多，形成灰白色假膜（C错）、疼痛明显（D错）是多形性红斑的口腔病损表现，多形性红斑皮肤病损无此表现。